年轻恒牙外伤后，牙齿松动但没有位置改变属于
A. 牙齿震荡
B. 亚脱位
C. 牙齿挫入
D. 半脱出
E. 侧向移位

正确答案：B。亚脱位

解析：亚脱位：临床表现为牙齿松动，但没有位置改变。掌握“年轻恒牙外伤”知识点。